根据《药品经营管理规范实施细则》，药品零售企业的营业店堂应做到
A. 陈列药品的类别标签应放置准确、字迹清晰
B. 明示服务公约、公布监督电话、设置顾客意见簿
C. 陈列药品的货柜保持清洁和卫生
D. 对顾客放映的问题，请坐堂医生解决
E. 对陈列药品应按月进行检查

正确答案：A、B、C、E。陈列药品的类别标签应放置准确、字迹清晰；明示服务公约、公布监督电话、设置顾客意见簿；陈列药品的货柜保持清洁和卫生；对陈列药品应按月进行检查

解析：本题考查药品经营管理。药品零售企业的营业店堂应做到：（1）陈列药品的货柜及橱窗应保持清洁和卫生（C对）。（2）陈列药品应按品种、规格、剂型或用途分类整齐摆放，类别标签应放置准确、字迹清晰（A对）。（3）对陈列的药品应按月进行检查，发现质量问题要及时处理（E对）。（4）药品零售企业和零售连锁门店应在营业店堂明示服务公约，公布监督电话和设置顾客意见簿（B对）。